下列方法中，用于体内样品处理的有
A. 蛋白沉淀法
B. 缀合物水解法
C. 液-液萃取法
D. 固相萃取法
E. 化学衍生化法

正确答案：A、B、C、D、E。蛋白沉淀法；缀合物水解法；液-液萃取法；固相萃取法；化学衍生化法

解析：本题考查体内样品处理方法。体内样品处理的方法包括：蛋白沉淀法（A对）、缀合物水解法（B对）、液-液萃取法（C对）、固相萃取法（D对）、化学衍生化法（E对）。